单胺氧化酶抑制剂并用氯丙嗪，即增强安定作用又可降压，此为
A. 作用于同一作用点或受体的相互作用
B. 作用于不同作用点或受体的相互作用
C. 敏感化现象
D. 竞争性拮抗作用
E. 非竞争性拮抗作用

正确答案：B。作用于不同作用点或受体的相互作用